虚里按之其动微弱的临床意义是
A. 心阳不足
B. 心肺气绝
C. 宗气内虚
D. 外感热邪
E. 惊恐所致

正确答案：C。宗气内虚

解析：虚里按之其动微弱者为不及，多是宗气内虚之征（C对）。心阳不足常见虚里搏动迟弱（A错）。心肺气绝常见虚里搏动散漫而数，伴胸高而喘（B错）。外感热邪常见虚里动高，聚而不散（D错）。惊恐常见虚里动高（E错）。